aVF导联ST段抬高0.2mV，最可能出现的心律失常是
A. 阵发性室上性心动过速
B. 房室传导阻滞
C. 室性期前收缩
D. 房性期前收缩
E. 心房颤动

正确答案：B。房室传导阻滞

解析：患者老年男性，持续胸痛4小时，心电图提示：Ⅱ、Ⅲ、aVF导联（提示下壁心肌梗死）ST段抬高0.2mV，考虑诊断为急性下壁心肌梗死。而下壁心肌梗死最可能出现的心律失常是房室传导阻滞（B对）。前壁心肌梗死多引起室性心律失常如室性期前收缩（C错）等。阵发性室上性心动过速（A错）可见于急性心肌梗死，低血钾症、心力衰竭、慢性阻塞性肺疾患等，亦可见于无任何病因，或由于情绪激动、过度疲劳、吸烟、饮酒诱发。房性期前收缩（P185）（D错）可见于正常人，也可见于冠心病、心肌病等。心房颤动（P188）（E错）可见于正常人，也可发生于冠心病、风湿性心脏病等。后三者虽然可在心肌梗死时出现，但都并非下壁心肌梗死最常见的心律失常。